男性，60岁，排尿困难3个月，体检发现前列腺变硬，为排除前列腺癌，最有价值的实验室检查是
A. 血癌胚抗原
B. 血酸性磷酸酶
C. 血甲胎球蛋白
D. 血碱性磷酸酶
E. 前列腺特异性抗原（PSA）

正确答案：E。前列腺特异性抗原（PSA）